原发性肾小球疾病的发病机制，多数是
A. 链球菌感染所致
B. 病毒感染所致
C. 药物所致
D. 免疫介导性炎症所致
E. 遗传变异基因所致

正确答案：D。免疫介导性炎症所致

解析：肾小球疾病是指一组有相似临床表现，如血尿和（或）蛋白尿，但病因、发病机制、病理改变、病程和预后不尽相同，病变主要累及双肾肾小球的疾病。原发性肾小球疾病大多数是特发的（即发病原因不明），其发病机制多数是免疫介导性炎症所致（D对），少部分由链球菌感染、病毒感染或药物所致（ABC错）。一般认为，免疫机制是肾小球疾病的始发机制，在此基础上炎症介质（如补体、细胞因子、活性氧等）的参与，最后导致肾小球损伤和产生临床症状。遗传变异基因所致（E错）肾小球疾病属于遗传性肾小球疾病。